男性，59岁，有咳嗽史7年，肺功能测定：肺活量占预计值百分比为84%，FEV₁/FVC为54%，最可能的诊断是
A. 弥散功能障碍
B. 限制性通气功能障碍
C. 阻塞性通气功能障碍
D. 混合性通气功能障碍
E. 正常

正确答案：C。阻塞性通气功能障碍

解析：不完全可逆性气流受限是慢阻肺诊断的必备条件，不完全可逆性气流受限依据吸入支气管管舒张药后FEV₁/FVC＜70%及FEV₁＜80%预计值可确定。慢性阻塞性肺疾病Ⅰ及轻度FEV₁/FVC＜70%及FEV₁≥80%预计值，有或无慢性咳嗽、咳痰症状。该患者肺活量占预计值百分比为84%，FEV₁/FVC为54%，可诊断为阻塞性通气功能障碍（C对）。